女，62岁，发现肺结核20年，未曾正规治疗，X线胸片示：右上肺4cm大小的球型病灶，其内有1.5～2cm的空洞，右肺内见纤维索条状阴影，纵隔右移，右侧胸膜肥厚，左下肺可见散在钙化灶，该病人的诊断是
A. 浸润型肺结核
B. 结核性胸膜炎
C. 慢性血行播散型肺结核
D. 结核球
E. 慢性纤维空洞型肺结核

正确答案：E。慢性纤维空洞型肺结核

解析：患者为老年女性，长期肺结核病史，没有正规治疗，X线胸片示：右上肺4cm大小的球型病灶，其内有1.5～2cm的空洞（提示纤维厚壁空洞），右肺内见纤维索条状阴影（广泛纤维增生），纵隔右移（患侧肺组织收缩），右侧胸膜肥厚，左下肺可见散在钙化灶，根据其临床表现和辅助检查，提示慢性纤维空洞型肺结核（E对）（纤维空洞型肺结核多见于长期结核病史患者，病情反复恶化而引起）。浸润型肺结核（A错）（P68）病变和纤维干酪增殖病变多发生在肺尖和锁骨下，影像学检查表现为小片状或斑点状阴影，可融合和形成空洞，无纤维厚壁空洞和广泛纤维增生。结核性胸膜炎（B错）（P118）多见于青年人，常有发热、干咳、胸痛，随着胸水量的增加胸痛可缓解，但可出现胸闷气促。慢性血行播散型肺结核（C错）（P67）起病较缓，症状较轻，X线胸片呈双上、中肺野为主的大小不等、密度不同和分布不均的粟粒状或结节状阴影，新鲜渗出与陈旧硬结和钙化病灶共存。结核球（D错）（P68）多由干酪样病变吸收和周边纤维膜包裹或干酪空洞阻塞性愈合而形成。结核球内有钙化灶或液化坏死形成空洞，同时80%以上的结核球有卫星灶，直径在2～4cm之间，多小于3cm，与本病厚壁空洞有明显区别。